肉桂具有的功效是
A. 温通经脉
B. 回阳救逆
C. 温肺化饮
D. 疏肝下气
E. 温中降逆

正确答案：A。温通经脉

解析：该题考查肉桂的功效。肉桂味辛、甘，性大热；入肾、脾、心、肝经；具有补火助阳，散寒止痛，温经通脉，引火归原的功效（A对BCDE错）。